国家药品标准的核心是
A. 中国药典
B. 企业标准
C. 药品注册标准
D. 行业标准
E. 炮制规范

正确答案：A。中国药典

解析：本题考查的是药品标准的主要类别。国家药品标准的核心是中国药典（A对）。药品标准的主要类别：1.《中国药典》：由国家药典委员会组织编纂，国家药品监督管理部门批准并颁布。《中国药典》是国家药品标准的核心，是具有法律地位的药品标准，拥有最高的权威性。《中国药典》于1953年编纂出版第一版以后，相继于1963年、1977年分别编纂出版。从1985年起每5年修订颁布新版药典。2.国家药品监督管理部门颁布的其他药品标准：为了促进药品生产，提高药品质量和保证用药安全，除《中国药典》收载的国家药品标准外，尚有《国家食品药品监督管理局国家药品标准》（简称“局颁药品标准”，或“局颁标准”），也收载了国内已有生产、疗效较好，需要统一标准但尚未载入药典的品种质量标准。现有国家药品监督管理部门颁布的新药转正标准、《国家食品药品监督管理局国家药品标准》、国家中成药标准汇编（中成药地方标准升国家标准部分）等标准的性质与《中国药典》相似，也具有法律约束力，同样是检验药品质量的法定依据。3.药品注册标准（C错）：药品注册标准是指国家药品监督管理部门核准给申请人特定药品的质量标准。药品应当符合国家药品标准和经国家药品监督管理局核准的药品质量标准。药品注册标准应当符合《中国药典》通用的技术要求，不得低于《中国药典》的规定。申报品种的检测项目或者指标不适用《中国药典》的，申请人应当提供充分的支持性数据。法定标准是包括中国药典在内的国家药品标准和经国务院药品监督管理部门核准的药品质量标准；非法定标准有行业标准（C错）、团体标准、企业标准（B错）等。法定标准属于强制性标准，是药品质量的最低标准，拟上市销售的任何药品都必须达到这个标准；企业标准只能作为企业的内控标准，各项指标均不得低于国家药品标准。国务院药品监督管理部门颁布的《中华人民共和国药典》和药品标准为国家药品标准。《药品管理法》还规定，中药饮片必须按照国家药品标准炮制；国家药品标准没有规定的，必须按照省级药品监督管理部门制定的炮制规范炮制（E错）。省级药品监督管理部门制定的炮制规范应当报国家药品监督管理部门备案。